胸骨左缘第2肋间有粗糙响亮的连续性机械样杂音
A. 房间隔缺损
B. 室间隔缺损
C. 动脉导管未闭
D. 法洛四联症
E. 复杂性先心病

正确答案：C。动脉导管未闭

解析：动脉导管未闭（C对）的特征为在胸骨左缘第2肋间有粗糙响亮的连续性机械样杂音。房间隔缺损（A错）特征性听诊表现为胸骨左缘第2、3肋间有2～3级柔和的收缩期吹风样杂音。室间隔缺损（B错）典型体征为胸骨左缘3、4肋间有4～5级粗糙收缩期杂音。法洛四联症（D错）为胸骨左缘常可闻及收缩期喷射样杂音。复杂先心病（E错）听诊复杂，表现各异。